妊娠合并心脏病气虚血瘀证的治疗方剂为
A. 养心汤
B. 归脾汤
C. 真武汤合五苓散
D. 补阳还五汤合瓜萎薤白半夏汤
E. 柏子仁丸

正确答案：D。补阳还五汤合瓜萎薤白半夏汤

解析：妊娠合并心脏病之气虚血瘀证的病机是心气虚而致心血不利，瘀血闭阻，治宜益气化瘀，通阳安胎，方用补气，活血，通络的补阳还五汤合通阳散结，祛痰宽胸的瓜萎薤白半夏汤（D对）。妊娠合并心脏病的阳虚水泛证方用真武汤合五苓散（C错）。养心汤（A错）主治妊娠合并心脏病之心气虚证；归脾汤（B错）主治妊娠合并心脏病之心血虚证；柏子仁丸（E错）主治阴血亏虚，心肾失调。